与执业药师相类似的是
A. 执业药师
B. 国内的药师、主管药师及主任药师等
C. 国外的药师
D. 临床药师
E. 从业药师

正确答案：C。国外的药师